新生儿缺氧缺血性脑病最常见的原因是
A. 产伤
B. 脑血管栓塞
C. 贫血
D. 发绀型先天性心脏病
E. 围生期窒息

正确答案：E。围生期窒息